硫脲类抗甲状腺药的主要药理作用是
A. 影响碘的摄取
B. 抑制甲状腺素
C. 干扰甲状腺素的作用
D. 抑制甲状腺素的生物合成
E. 干扰促甲状腺素的分泌

正确答案：D。抑制甲状腺素的生物合成